下列各项，不属于宫颈锥形切除术适应证的是
A. 宫颈轻、中度不典型增生
B. 疑有宫颈管内癌变
C. 宫颈刮片多次异常而活检未发现病变
D. 宫颈重度糜烂
E. 宫颈息肉

正确答案：E。宫颈息肉

解析：宫颈锥形切除术常作为重度宫颈糜烂与轻、中度不典型增生的治疗手段（AD对）。用于怀疑宫颈管内有癌变者（B对）。用于宫颈刮片多次异常而宫颈活组织检查未能发现病变者（C对）。宫颈息肉可作息肉摘除，抗炎治疗定期复查，无需做宫颈锥形切除术（E错，为本题正确答案）。